学校卫生监督是由什么机构进行的执法活动
A. 教育行政部门
B. 卫生行政部门
C. 本地区疾控中心
D. 中小学卫生保健机构
E. 市级以上疾控中心

正确答案：B。卫生行政部门